额部对应的脏腑是
A. 肝
B. 心
C. 脾
D. 肺
E. 肾

正确答案：B。心

解析：面部分候脏腑，是将面部不同部位分候不同的脏腑，通过观察面部不同部位色泽的变化，以诊察相应脏腑的病变，根据《内经》的有关论述，具体分候方法有两种：《灵枢·五色》分候法和《素问·刺热》分候法，后者为：“额部候心，鼻部候脾，左颊候肝，右颊候肺，颏部候肾”，故《素问·刺热》中，以额部候心（B对）。肝对应的部位为左颊(A错)。脾对应的部位为鼻部（C错）。肺对应的部位为右颊（D错）。肾对应的部位为颏部（E错）。